肾病患者忌服的药是
A. 枳壳
B. 柿蒂
C. 荔枝核
D. 川楝子
E. 青木香

正确答案：E。青木香

解析：本题考查的是青木香的注意。肾病患者忌服的药物是青木香（E对）。青木香：【注意】因青木香可引起肾脏损害，原国家食品药品监督管理局于2004年发布通知，取消青木香的药用标准，凡国家药品标准处方中含有青木香的中成药品种应将处方中的青木香替换为《中国药典》收载的土木香（仅限于以菊科植物土木香的干燥根替换）。枳壳（A错）：【使用注意】本品苦泄辛散，大量服用、久服有耗气之虞。柿蒂（B错）：【主治病证】胃失和降之呃逆证。荔枝核（C错）：使用注意】本品微苦泄散、温通，能耗气助热，故气虚或有内热者慎服。川楝子（D错）：【使用注意】本品苦寒，有小毒，故不宜超量服用，脾胃虚寒者慎服。